关于非创伤性修复充填的适应证，错误的是
A. 恒牙中龋
B. 乳牙中龋
C. 恒牙小龋洞
D. 乳牙深龋
E. 乳牙小龋洞

正确答案：D。乳牙深龋

解析：本题考查非创伤性修复充填的适应证。关于非创伤性修复充填的适应证，错误的是乳牙深龋（D错，为本题正确答案）。非创伤性修复治疗适用于无牙髓暴露、无可疑牙髓炎的恒牙中龋（A对）、乳牙中龋（B对）和恒牙小龋洞（C对）、乳牙小龋洞（E对），能允许最小的挖器进入。